患者，女，45岁。一年前临床诊断为室上性心动过速，服用美托洛尔片25mgbid近日因反复胃痛就诊，胃镜检查诊断为胃溃疡，幽门螺杆菌阳性，医师处方：埃索美拉唑镁肠溶片20mgbid，甲硝唑片04gbid，克拉霉素片5Omgbid，枸橼酸铋钾胶囊0.6gbid。该患者如长期服用埃索美拉唑镁肠溶片，可能会导致
A. 维生素A缺乏
B. 维生素B₂缺乏
C. 维生素B₁₂缺乏
D. 维生素B₆缺乏
E. 维生素D缺乏

正确答案：C。维生素B₁₂缺乏

解析：本题考查埃索美拉唑的不良反应。埃索美拉唑为质子泵抑制剂，长期服用影响钙吸收，可致骨质疏松；维生素B₁₂和维生素C吸收下降（C对），增加感染风险，便秘、口干。